尿负荷试验评价维生素C的营养状况，维生素C水平正常时排出量是
A. ＜3mg
B. ＜5mg
C. 3～5mg
D. 5～10mg
E. 5～13mg

正确答案：E。5～13mg